有机磷酸酯类中毒症状中，不属于M样症状的是
A. 瞳孔缩小
B. 流涎流泪
C. 腹痛腹泻
D. 小便失禁
E. 肌肉震颤

正确答案：E。肌肉震颤

解析：有机磷酸酯类中毒的表现是体内乙酰胆碱大量积聚并作用于胆碱受体引起的。分为M样作用与N样作用。M样作用症状：多数眼睛缩瞳；腺体分泌增加，流涎，出汗，中毒严重的患者可出现大汗淋漓；呼吸系统：支气管腺体分泌增加，支气管痉挛，引起呼吸困难，严重时出现肺水肿；肠道平滑肌兴奋引起恶心、呕吐，腹泻、腹痛；膀胱逼尿肌兴奋引起大小便失禁；此外还有心动过缓、血压下降等。N样作用症状：肌肉震颤、抽搐，常从颜面部开始并波及全身。掌握“难逆性抗胆碱酯酶药及胆碱酯酶复活药”知识点。